以下哪种调查方法可以提供某种或某些疾病的流行因素的线索，形成危险因子假设
A. 纵向调查
B. 横断面调查
C. 临床试验
D. 组群调查
E. 常规资料分析

正确答案：B。横断面调查

解析：利用横断面调查可以提供某种或某些疾病的流行因素的线索，形成危险因子假设。掌握“口腔流行病学概述及研究方法”知识点。